“壮水之主，以制阳光”治法的适应证是
A. 阳虚
B. 阴虚
C. 阳盛
D. 阴盛
E. 阴阳两虚

正确答案：B。阴虚

解析：本题考查的是阴阳学说的临床应用。“壮水之主，以制阳光”治法的适应证是阴虚（B对）。阴虚不能制阳而致阳亢者，属虚热证，一般不能用寒凉药直折其热，须“壮水之主，以制阳光”，即用滋阴壮水之法以抑制阳亢火盛，这种治疗原则亦称为“阳病治阴”。若阳虚（A错）不能制阴而造成阴盛者，属虚寒证，不宜用辛温发散药以散阴寒，须“益火之源，以消阴翳”，即用扶阳益火之法以消退阴盛，这种治疗原则也称为“阴病治阳”。阳盛（C错）：又称“阳偏盛”，是指机体在疾病过程中，出现的阳邪偏盛、功能亢奋、热量过剩的病机变化。病机特点多表现为阳盛而阴未虚的实热证。阴盛（D错）：又称“阴偏盛”，是指机体在疾病过程中所出现的一种阴邪偏盛、功能障碍或减退、产热不足，以及病变性代谢产物积聚的病机变化，其病机特点多表现为阴盛而阳未虚的实寒证。对阴阳两虚（E错）证，则采用阴阳并补治法。但须分清主次而用，阳损及阴者，以阳虚为主，则应在补阳的基础上辅以滋阴之品；阴损及阳者，以阴虚为主，则应在滋阴的基础上辅以补阳之品。